早期成人牙周炎患者临床主要症状是
A. 牙齿移位
B. 食物嵌塞
C. 刷牙或进食时牙龈出血
D. 牙龈退缩
E. 牙齿松动

正确答案：C。刷牙或进食时牙龈出血

解析：本题考查早期慢性牙周炎的临床主要症状。成人牙周炎在新分类法中归为慢性牙周炎。慢性牙周炎早期主要症状是刷牙或进食时牙龈出血（C对）。慢性牙周炎患者除有牙周袋形成、牙龈炎症、牙周附着丧失、牙槽骨吸收的主要特征外，晚期常可出现其他伴发病变和症状，如：①牙齿移位、倾斜；②由于牙松动、移位和龈乳头退缩，造成食物嵌塞；③由于牙周支持组织减少，造成继发性（牙合）创伤；④牙龈退缩使牙根暴露，对温度刺激敏感，还可发生根面龋；⑤深牙周袋内脓液引流不畅时，或身体抵抗力降低时，可发生急性牙周脓肿；⑥深牙周袋接近根尖时，可引起逆行性牙髓炎；⑦牙周袋溢脓和牙间隙内食物嵌塞，可引起口臭等。综上所述，牙松动（E错）、牙齿移位（A错）、牙龈退缩（D错）、食物嵌塞（B错）等是慢性牙周炎晚期出现的伴发病变或症状。